X线片诊断根尖周囊肿的指标是
A. 椭圆形透射区，边界较清晰，周围骨质疏松
B. 较大圆形透射区，边界清楚，周围有阻射白线
C. 透射区形态不规则，边缘模糊，周围骨质稀疏
D. 透射区形态不规则，边缘清楚，周围稍致密
E. 椭圆形透射区，边界模糊，周围骨质稍致密

正确答案：B。较大圆形透射区，边界清楚，周围有阻射白线

解析：本题考查X线检查显示出患牙根尖区骨质变化的影像。不同的X线影像有时可提示慢性根尖周炎的类型。其中，X线片诊断根尖周囊肿的指标是较大圆形透射区，边界清楚，周围有阻射白线（B对ADE错）。透射区形态不规则，边缘模糊，周围骨质稀疏（C错）考虑为根尖周脓肿。根尖周肉芽肿X线片表现为根尖部投射影圆形，直径小于1cm，边界清楚，周围骨质正常或稍显致密。根尖周致密性骨炎表现为根尖部骨质呈局限性的致密阻射影像，无透射区，多在下颌后牙发现。